16s（正常对照17s）。该患者出血最可能的原因是
A. 纤维蛋白原缺乏
B. 维生素K缺乏
C. 凝血因子X缺乏
D. 凝血酶原缺乏
E. 凝血因子Ⅸ缺乏

正确答案：E。凝血因子Ⅸ缺乏

解析：青年男性，拔牙后出血不止2天（常见凝血障碍疾病症状），查体和实验室检查除APTT延长（提示内源性凝血障碍）外无明显异常，结合上述临床表现和实验室检查，患者最可能的诊断是血友病B，出血最可能的原因是凝血因子Ⅸ缺乏（E对）。纤维蛋白原缺乏（A错）、维生素K缺乏（B错）、凝血因子X缺乏（C错）、凝血酶原缺乏（D错）时，PT均延长。